男性，61岁，患有高血压，同时伴有2型糖尿病，尿蛋白（+），选择最佳降压药物为
A. 利尿剂
B. 钙拮抗剂
C. ACEI
D. α受体阻滞剂
E. β受体阻滞剂

正确答案：C。ACEI

解析：患者老年男性，高血压合并糖尿病，有蛋白尿，最佳降压药物应为ACEI（血管紧张素转换酶抑制剂）（C对）。因为ACEI可抑制交感-肾素-血管紧张素-醛固酮系统，扩张外周血管而降低血压；还可改善胰岛素抵抗、减少尿蛋白形成，因此特别适合于高血压合并糖尿病的患者。利尿剂（A错）可使血脂、血糖、血尿酸升高，β受体阻滞剂（P253）（E错）能增加胰岛素抵抗，还可能掩盖和延长低血糖反应，两者都不适合用于糖尿病伴高血压患者。钙通道阻滞剂（P255）（B错）对血脂、血糖等无明显影响，可用于高血压合并糖尿病患者，但并非首选用药。用于抗高血压治疗的α受体阻滞剂（D错）主要为α₁受体阻滞剂，如哌唑嗪、特拉唑嗪等，因其副作用较多，目前不主张单独使用。